发病时间不长的创伤性根尖周炎首选治疗是
A. 观察
B. 开髓开放
C. 调（牙合）
D. 龈上洁治
E. 根管治疗

正确答案：C。调（牙合）

解析：患者有咀嚼痛伴有叩痛，发病时间不长，创伤性根尖周炎或牙周炎不严重，通过调（牙合），症状就会很快消失。掌握“修复体戴入后的问题及处理”知识点。